下列有关试戴可摘局部义齿铸造支架初戴说法正确的是
A. 就位是否顺利
B. 卡环位置是否合适
C. 确认铸造支架有无变形
D. 支托或支架是否存在咬合高点
E. 以上说法均正确

正确答案：E。以上说法均正确

解析：试戴可摘局部义齿铸造支架，确认铸造支架有无变形，就位是否顺利，卡环位置是否合适，支托或支架是否存在咬合高点等。掌握“局部义齿的初戴”知识点。